男，46岁。因直肠癌入院。癌肿距离肛缘5cm，大小为2cm×lcm。拟行手术治疗，患者强烈要求保留肛门。该患者适合保肛的病理依据是癌肿
A. 周围淋巴结状况
B. 浸润肠壁的深度
C. 是否侵及泌尿系统
D. 向下的纵向浸润范围
E. 组织学分类

正确答案：D。向下的纵向浸润范围

解析：病人是否可以保肛主要取决于癌肿下缘距齿状线的距离，即癌肿向下的纵向浸润范围（D对），此距离大于5cm时，多采用保留肛门的术式。周围淋巴结状况（A错）、浸润肠壁的深度（B错）、是否侵及泌尿系统（C错）、组织学分类（E错）可作为手术方式的参考，但不是决定手术方式的最主要因素。